有良好证据支持的药物信息属于
A. EBDIA类
B. EBDIB类
C. EBDIC类
D. EBDID类
E. EBDIE类

正确答案：A。EBDIA类